下列各项中，不属于冠心病中医病因的是
A. 七情内伤
B. 饮食失节
C. 寒邪内侵
D. 劳逸失度
E. 禀赋不足

正确答案：E。禀赋不足

解析：冠心病是寒邪内侵、七情内伤（A对）、饮食失节（B对）、寒邪内侵（C对）、劳倦内伤（D对）、年老体衰等多种因素交互为患，引起心脉不畅而发为本病。（E错，为本题正确答案）。